龋病二级预防的内容不包括
A. 定期口腔检查
B. X线辅助诊断
C. 窝沟封闭
D. 早期诊断
E. 早期治疗

正确答案：C。窝沟封闭

解析：龋病的二级预防：早期诊断早期处理，定期进行临床检查及X线辅助检查，发现早期龋及时充填。掌握“龋病三级预防”知识点。